符合迁延性肺炎的病程是
A. 7～14天
B. 2～3周
C. 1～3个月
D. 3～6个月
E. 6～9个月

正确答案：C。1～3个月